阿托品可用于缓解
A. 癌性疼痛
B. 分娩疼痛
C. 内脏绞痛
D. 严重创伤疼痛
E. 牙痛

正确答案：C。内脏绞痛

解析：本题考查阿托品。阿托品可松弛内脏平滑肌，可用于缓解内脏绞痛（C对）；阿托品不具有镇痛作用，对癌性疼痛（A错）、分娩疼痛（B错）、严重创伤疼痛（D错）及牙痛（E错）无效。